五灵脂具有的功效是
A. 行血补血
B. 利尿通淋
C. 化瘀止血
D. 消肿排脓
E. 消积杀虫

正确答案：C。化瘀止血

解析：本题考查的是五灵脂的功效。五灵脂具有的功效是化瘀止血（C对）。五灵脂：【功效】活血止痛，化瘀止血，解蛇虫毒。鸡血藤：【功效】活血补血（A错），调经止痛，舒筋活络。川牛膝：【功效】逐瘀通经，通利关节，利尿通淋（B错），引血下行。穿山甲：【功效】活血消癥，通经下乳，消肿排脓（D错）。使君子：【功效】杀虫消积（E错）。